青霉素类引起的过敏性休克首选
A. 去甲肾上腺素
B. 异丙肾上腺素
C. 肾上腺素
D. 多巴胺
E. 麻黄碱

正确答案：C。肾上腺素

解析：过敏性休克可收缩小动脉和毛细血管前括约肌，降低毛细血管的通透性；改善心功能，缓解支气管痉挛；减少过敏介质释放，扩张冠状动脉，从而迅速缓解过敏性休克的临床症状，挽救病人的生命，为治疗过敏性休克的首选药。掌握“肾上腺素”知识点。